地表水环境质量标准中反映有机污染物污染程度指标是
A. 水温
B. pH
C. 五日生化需氧量
D. 溶解氧
E. “三氮”量

正确答案：C。五日生化需氧量

解析：本题考查生化需氧量的相关内容。生化需氧量指水中有机物在有氧条件下被需氧微生物分解时消耗的溶解氧量。水中有机物愈多，生化需氧量愈高。生物氧化过程与水温有关，在实际工作中规定以20℃培养5日后，1L水中减少的溶解氧量为5日生化需氧量（C对ABDE错），它是反映有机污染物污染程度的指标。